男，42岁。寒战、高热、尿频、尿急、尿痛、排尿困难、会阴部胀痛1天。查体：尿道口无分泌物和红肿。首先考虑的疾病是
A. 膀胱结石
B. 急性前列腺炎
C. 急性尿道炎
D. 急性膀胱炎
E. 急性附睾炎

正确答案：B。急性前列腺炎

解析：中年男性患者，寒战、高热（提示感染）、尿频、尿急、尿痛、排尿困难、会阴部胀痛1天（提示泌尿系统疾病）。查体：尿道口无分泌物和红肿（提示无尿道感染），结合患者病史、临床表现，首先考虑的疾病是急性前列腺炎（B对）。膀胱结石（A错）的典型症状为排尿突然中断，疼痛放射至远端尿道及阴茎头部，伴排尿困难和膀胱刺激症状（P562）。急性尿道炎（C错）由淋病奈瑟菌或非淋病奈瑟菌的病原体所致，尿道排出较多脓性分泌物，排尿不适（P539）。急性膀胱炎（D错）常见终末血尿或全程血尿，可有血块排出，全身症状不明显（P537）。急性附睾炎（E错）阴囊明显肿胀，阴囊皮肤发红、发热、疼痛（P542）。